固定义齿牙槽嵴的吸收超过基牙根长多少时，应考虑增加基牙
A. 0.5
B. 0.66666666666667
C. 0.33333333333333
D. 0.25
E. 0.2

正确答案：C。0.33333333333333

解析：对于固定义齿，牙槽嵴吸收超过根长的1/3应考虑增加基牙。掌握“固定桥的生理基础”知识点。